临床分级为轻、中度溃疡性结肠炎的首选治疗药物是
A. 强的松
B. 6-MP
C. 柳氮磺吡啶
D. 替硝唑
E. 羟氨苄青霉素

正确答案：C。柳氮磺吡啶

解析：溃疡性结肠炎可分为轻度中度和重度。轻度：腹泻＜4次/日，便血轻或无，无发热，贫血无或轻，血沉正常。重度：腹泻＞6次/日，有明显黏液脓血便，体温＞37.5℃、脉搏＞90次/分，血红蛋白＜100g/L,血沉＞30mm/h。中度介于轻度与重度之间。轻中度溃疡性结肠炎选用5-氨基水杨酸制剂和柳氮磺吡啶（C对）治疗，重度溃疡性结肠炎首选糖皮质激素，对激素治疗效果不佳或对激素依赖的慢性持续型病例可选用免疫抑制剂。